女，45岁，既往月经正常，近1年来经期延长10～15天，量多，此次停经50天，后有阴道出血20天，血红蛋白80g/L，盆腔检查（一），基础体温单相。如通过检查排除宫体癌后，应考虑为
A. 子宫黏膜下肌瘤
B. 子宫内膜炎
C. 子宫内膜息肉
D. 无排卵性异常子宫出血
E. 排卵性异常子宫出血

正确答案：D。无排卵性异常子宫出血

解析：中年女性，既往月经正常，近1年来经期延长，量多，此次停经50天，后有阴道出血20天，血红蛋白80g/L（正常值为大于110g/L，提示贫血），盆腔检查（一），基础体温单相（提示无排卵），如通过检查排除宫体癌后，根据患者的临床症状、体征及实验室检查，考虑最可能的诊断为无排卵性异常子宫出血（D对），该病的主要表现为失去正常周期和出血自限性。子宫黏膜下肌瘤（A错）主要表现为经期延长和经量增多，下腹部可触及肿块，且排卵正常。子宫内膜炎（B错）主要表现为发热、下腹痛、分泌物增多，严重时可伴有经量增多及经期延长。子宫内膜息肉（C错）虽然也存在经量增多及经期延长的症状，排卵是正常的。排卵性异常子宫出血（E错）基础体温则为双相。